男性，45岁。右下腹隐痛4个月，近2个月来乏力、消瘦，常有低热，查体：结膜苍白，右侧腹部5cm×3cm肿块。化验：血红蛋白95g/L。为明确诊断，最有意义的检查方法是
A. 直肠指检
B. 腹部CT
C. X线钡剂灌肠
D. 纤维结肠镜
E. X线气钡双重对比造影

正确答案：D。纤维结肠镜

解析：患者出现低热、乏力、消瘦（全身症状），血红蛋白95g/L（正常值≥120g/L，低于正常值即为贫血），右侧肿块，考虑为右侧结肠癌。纤维结肠镜可以直观的看到病变部位、范围及病变程度，并可取活组织以进行病理检查，为明确诊断，最有意义的检查方法是纤维结肠镜（D对）。直肠指检（A错）是直肠癌检查时首选的检查方法，对结肠癌无确诊意义。腹部CT（B错）、X线钡剂灌肠（C错）、X线气钡双重对比造影（E错）均有助于发现肿物，但属于间接成像技术，不具有确诊价值。